老年骨质疏松患者在维生素D加钙制剂的基础上，可联合选用
A. 尼尔雌醇
B. 阿仑膦酸钠
C. 氢氯噻嗪
D. 尿促红素
E. 苯妥英钠

正确答案：B。阿仑膦酸钠

解析：本题考查骨质疏松症的药物治疗。老年骨质疏松患者在维生素D加钙制剂的基础上，可联合选用一种骨吸收抑制剂（以双膦酸盐尤其是阿仑膦酸钠（B对））的三联药物治疗。尼尔雌醇（A错）与维生素D和钙制剂联合用于绝经后妇女由于缺少雌激素而引起的骨质疏松。氢氯噻嗪（C错）为利尿药、抗高血压药。尿促红素（D错）治疗垂体功能低下的无排卵患者。苯妥英钠（E错）为抗癫痫药、抗心律失常药。